天南星的主治病证是
A. 风痰眩晕，破伤风
B. 肺热痰稠咳喘
C. 新久咳嗽，肺痨咳嗽
D. 顽痰，老痰胶结，气逆咳喘实证
E. 痰涎壅盛，咳嗽气喘

正确答案：A。风痰眩晕，破伤风

解析：天南星苦泄辛散温行，入肝经，可通行经络，尤善祛风痰，止痉搐；治风痰眩晕，配半夏、天麻等；治破伤风，角弓反张，痰涎壅盛者，则配白附子、天麻、防风等，如玉真散（A对）。天南星的功效为燥湿化痰，祛风止痉，散结消肿。可用于治疗顽痰咳喘，胸膈胀闷；风痰眩晕，中风痰壅，口眼㖞斜，半身不遂，癫痫，惊风，破伤风；痈肿，瘰疬痰核，蛇虫咬伤。